申请经营药品类易制毒化学品的审批部门是
A. 国务院药品监督管理部门
B. 国务院卫生行政部门
C. 省人民政府安全生产监督管理部门
D. 省级药品监督管理部门
E. 省级卫生行政部门

正确答案：A。国务院药品监督管理部门

解析：本题考查药品类易制毒化学品的生产、经营许可。申请经营药品类易制毒化学品的审批部门是国务院药品监督管理部门（A对）。药品类易制毒化学品的生产、经营许可：1.生产、经营药品类易制毒化学品的企业，应当依照有关规定取得药品类易制毒化学品生产、经营许可。未取得生产许可或经营许可的企业不得生产或经营药品类易制毒化学品。药品类易制毒化学品的生产许可，由企业所在地省级药品监督管理部门（D错）审批。药品类易制毒化学品以及含有药品类易制毒化学品的制剂不得委托生产。2.药品类易制毒化学品单方制剂和小包装麻黄素，纳入麻醉药品销售渠道经营，仅能由麻醉药品全国性批发企业和区域性批发企业经销，不得零售。未实行药品批准文号管理的品种，纳入药品类易制毒化学品原料药渠道经营。3.申请经营药品类易制毒化学品原料药的药品经营企业，应具有麻醉药品和第一类精神药品定点经营资格或者第二类精神药品定点经营资格，否则，药品监督管理部门将不予受理。